理气药具有的功效是
A. 顺气降逆
B. 行气止痛
C. 化湿和中
D. 调气健脾
E. 疏肝解郁

正确答案：A、B、D、E。顺气降逆；行气止痛；调气健脾；疏肝解郁

解析：本题考查的是理气药的功效。理气药具有的功效是顺气降逆（A对）、行气止痛（B对）、调气健脾（D对）与疏肝解郁（E对）。凡以疏畅气机为主要功效的药物，称为理气药。本类药味多辛苦，气多芳香，性多偏温，主归脾、胃、肝、肺经，善于行散或泄降，主能理气调中、疏肝解郁、理气宽胸、行气止痛、破气散结，兼能消积、燥湿。化湿和中（C错）主要芳香化湿药的功效。凡气味芳香，以化湿运脾为主要功效的药物，称为芳香化湿药。本类药多辛香温燥，主入脾、胃经，功能化湿醒脾或燥湿运脾，兼解暑发表。